症见高热、头痛、呕吐，全身皮肤散在瘀点，颈项强直，最可能的诊断是
A. 结核性脑膜炎
B. 流行性脑脊髓膜炎
C. 流行性乙型脑炎
D. 伤寒
E. 中毒性细菌性痢疾

正确答案：B。流行性脑脊髓膜炎

解析：流行性脑脊髓膜炎（B对）的临床表现为突发高热、剧烈头痛、频繁呕吐、皮肤黏膜瘀点及脑膜刺激征；结核性脑膜炎（A错）发热为低热，皮肤无瘀点；流行性乙型脑炎（C错）无皮肤瘀点且有呼吸衰竭；伤寒（D错）无呕吐症状皮肤出现皮疹而不是瘀点；中毒性细菌性痢疾（E错）主要为腹泻腹痛等症状，无头痛呕吐，皮肤瘀点和颈项强直。